我国20世纪推出加工生产的标准米和标准粉，既保留较多的B族维生素、纤维素和无机盐，也节约了粮食和预防某些疾病，它们是
A. 九五米和八五粉
B. 八五米和九五粉
C. 七五粉和九五米
D. 八五粉和七五米
E. 以上都不对

正确答案：A。九五米和八五粉